大秦艽汤的功用是
A. 祛风清热，养血活血
B. 疏风养血，清热除湿
C. 疏风止血
D. 祛风化痰止痉
E. 祛风除湿，化痰通络

正确答案：A。祛风清热，养血活血

解析：本题考查大秦艽汤的功用，属记忆内容。本方主治：因正气不足，阴血虚弱，脉络空虚，风邪乘虚入中，气血痹阻，经络不畅，所导致的风邪初中经络证。大秦艽汤功用祛风清热，养血活血（A对）。趣记：大秦艽汤 独娇子黄细强活，八珍少人风高升。――独艽芷黄细羌活，八珍（少）人风膏生。